LDL
A. 运送内源性TG
B. 运送内源性Ch
C. 运送外源性TG
D. 蛋白质含量最高
E. 与冠状动脉粥样硬化的发生率呈负相关

正确答案：B。运送内源性Ch